某男，60岁。5年前被确诊为支气管哮喘，多在夜间发作。发作时顿感胸部胀闷，呼吸困难（呼气延长）并伴有哮鸣音、干咳和紫绀。为减轻气喘，常被迫坐起，经西医治疗，症情缓解。为进一步缓解病情遂请中医诊治。因煎药不便，希望服用中成药。刻下为支气管哮喘缓解期，症见咳嗽、痰多、喘息气促、动则喘剧，并伴有倦怠乏力、少气懒言，舌红苔薄白腻，脉沉而尺弱。证属脾虚痰盛、肾气不固，宜选用的中成药是
A. 七味都气丸
B. 蛤蚧定喘丸
C. 固本咳喘片
D. 麦味地黄丸
E. 人参保肺丸

正确答案：C。固本咳喘片

解析：本题考查的是固本咳喘片的主治。刻下属支气管哮喘缓解期，症见咳嗽、痰多、喘息气促、动则喘剧，并伴有倦怠乏力、少气懒言，舌红苔薄白腻，脉沉而尺弱。证属脾虚痰盛、肾气不固，宜选用的中成药是固本咳喘片（C对）。固本咳喘片：【主治】脾虚痰盛、肾气不固所致的咳嗽、痰多、喘息气促、动则喘剧；慢性支气管炎、肺气肿、支气管哮喘见上述证候者。七味都气丸（A错）：【主治】肾不纳气所致的喘促、胸闷、久咳、气短、咽干、遗精、盗汗、小便频数。蛤蚧定喘丸（B错）：【主治】肺肾两虚、阴虚肺热所致的虚劳久咳、年老哮喘、气短烦热、胸满郁闷、自汗盗汗。麦味地黄丸（D错）：【主治】肺肾阴亏，潮热盗汗，咽干咳血，眩晕耳鸣，腰膝酸软，消渴。人参保肺丸（E错）：【主治】肺气亏虚，肺失宣降所致的虚劳久嗽、气短喘促。